骨传导将声波传入内耳经
A. 颅骨
B. 第二鼓膜
C. 蜗孔
D. 前庭窗
E. 基底膜

正确答案：A。颅骨

解析：声音的传导分分空气传导和骨传导两条路径，而骨传导指声波经颅骨（A对）传入内耳的过程。